男，28岁。枕部着地，昏迷5分钟后清醒，并自己回到家中，其后出现头痛并逐渐加重伴呕吐，1小时后不省人事，急送医院。查体：BP160/90mmHg，脉率65次/分，呼吸15次/分。浅昏迷，右枕部头皮挫伤，左侧瞳孔4mm，对光反应消失；右侧瞳孔2.5mm，对光反应存在。最可能的诊断是
A. 颅脑肿瘤
B. 颅内血肿
C. 脑梗塞
D. 蛛网膜下腔出血
E. 脑挫伤

正确答案：B。颅内血肿

解析：青年男性患者，枕部外伤，昏迷5分钟后清醒，后再次陷入昏迷（昏迷→清醒→昏迷，为急性硬膜外血肿的典型表现）。左侧瞳孔4mm，对光反应消失；右侧瞳孔2.5mm，对光反应存在（双侧瞳孔不等大，左侧对光反射消失，提示左侧动眼神经受压）。综合患者的病史及体查，最可能的诊断是急性硬膜外血肿并小脑幕切迹疝。颅内血肿（B对）包括硬脑膜外血肿、硬脑膜下血肿和脑内血肿。颅脑肿瘤（P198）（A错）以颅内压增高和神经功能定位症状为主要表现，多无外伤史。脑梗塞（C错）即脑梗死，亦称缺血性脑卒中，多见于老年人，指因脑部血液供应障碍，缺血、缺氧所导致的局限性脑组织的缺血性坏死或软化，临床表现以猝然昏倒、不省人事、半身不遂、言语障碍、智力障碍为主要特征。蛛网膜下腔出血（D错）多见于颅内动脉瘤破裂、畸形脑血管破裂，以偏瘫、视力视野障碍为主要表现，极少见于颅脑外伤的患者。脑挫伤（P188）（E错）多表现为伤后立即出现的意识障碍，不会出现中间清醒期。